女，25岁，平时无出血倾向，食欲良好。检查发现红细胞3×10¹²/L，Hb90g/L，WBC8.0×10⁹/L。血清总胆红素82μmol/L，非结合胆红素62μmol/L，ALT20μ，ALP10μ。此病人黄疸可能属于
A. 溶血性
B. 肝细胞性
C. 肝内胆汁淤积性
D. 肝外胆汁淤积性
E. 药物性胆汁淤积

正确答案：A。溶血性

解析：女，25岁，平时无出血倾向，食欲良好（排除其他影响因素）。检查发现红细胞3×10¹²/L（女性正常值为3.5～5.0×10¹²/L），Hb90g/L（女性正常值为110～150g/L），WBC8.0×10⁹/L（正常值为4～10×10⁹/L），提示患者存在贫血。血清总胆红素82μmol/L（正常值1.7～17.1μmol/L），非结合胆红素62μmol/L（正常值1.7～13.68μmol/L），ALT20U/L（正常值5～40U/L），ALP10U/L（正常值为40～150U/L），可诊断此病人的黄疸可能属于溶血性（A对）。溶血性黄疸时，常有贫血，血清总胆红素升高，以非结合胆红素增高为主，结合胆红素基本正常，因溶血性黄疸没有肝细胞及胆道细胞的破坏，血清酶正常。肝细胞性（B错）结合胆红素和非结合胆红素均增加，伴有不同程度的肝损害，表现为血清酶升高。胆汁淤积性黄疸可分为肝内胆汁淤积（C错）和肝外胆汁淤积（D错），以结合胆红素增加为主，非结合胆红素轻度增加，ALP（碱性磷酸酶）可有增高。药物性胆汁淤积（E错）多有服用某种药物史，多表现为肝外胆汁淤积。